入院病史记录不包括下列哪项记录
A. 一般入院记录
B. 24小时内入出院记录
C. 24小时内入院死亡记录等
D. 急诊病史记录
E. 再次或多次入院记录

正确答案：D。急诊病史记录

解析：本题考查口外病史记录。入院病史记录不包括急诊病史记录（D错，为本题正确答案）。入院病史记录：是指患者入院后，由经治医师通过问诊、查体、辅助检查获得有关资料，并对这些资料归纳分析书写而成的记录。可分为一般入院记录（A对）、再次或多次入院记录（E对）、24小时内入出院记录（B对）、24小时内入院死亡记录（C对）等。